研究各项因素同疾病频率之间和各因素之间的定量关系用数学方程式表示，揭示他们之间的相互关系
A. 描述流行病学
B. 分析流行病学
C. 实验流行病学
D. 理论流行病学
E. 血清流行病学

正确答案：D。理论流行病学